男孩，1.5岁。半后半年发现尿有怪臭味，一岁时发现智力较同龄儿童低，尿有霉臭味，近1个月经常抽搐发作。体检：表情呆滞，毛发棕黄，面部湿疹，皮肤白皙。应采取的治疗措施是
A. 观察，抽搐时给予止抽搐药物
B. 口服甲状腺片
C. 静推10%葡萄糖酸钙，同时口服维生素D
D. 限制苯丙氨酸摄入量
E. 口服碘化钾

正确答案：D。限制苯丙氨酸摄入量

解析：尿有鼠尿味为苯丙酮尿症（PKU）的特征性表现，患儿智能发育落后、头发色素变浅，间断抽搐，应诊断为PKU。PKU一旦确诊，应积极治疗，首选低苯丙氨酸饮食（D对），如牛奶、粥、面、蛋等，应根据血清苯丙氨酸浓度调节饮食。低苯丙氨酸饮食治疗至少持续到青春期后。抽搐时给予止抽搐药物为对症治疗措施（A错）。口服甲状腺片主要用于先天甲减的治疗（B错）。静推10%葡萄糖酸钙，同时口服维生素D主要用于维生素D缺乏性佝偻病的治疗（C错）。口服碘化钾主要用于甲危的治疗（E错）。